从含有皂苷的水溶液中萃取皂苷的常用溶剂是
A. 石油醚
B. 氯仿
C. 乙醚
D. 水饱和正丁醇
E. 苯

正确答案：D。水饱和正丁醇

解析：本题考查的是皂苷的溶解度。从含有皂苷的水溶液中萃取皂苷的常用溶剂是水饱和正丁醇（D对）。皂苷的溶解度：大多数皂苷极性较大，易溶于水、热甲醇和乙醇等极性较大的溶剂，难溶于丙酮、乙醚（C错）等有机溶剂。皂苷在含水正丁醇中有较大的溶解度，因此正丁醇常作为提取皂苷的溶剂。次级苷由于糖数目的减少极性降低，在水中溶解度减少，易溶于乙醇、丙酮、乙酸乙酯等。皂苷元则难溶于水而易溶于石油醚（A错）、苯（E错）、乙醚、三氯甲烷（B错）等低极性溶剂。皂苷有助溶性能，可促进其他成分在水中的溶解。